下列哪项不是气管及支气管异物的特点
A. 多见于学龄前儿童
B. 气管异物典型的三大体征是喘鸣、异物拍击声、异物撞击声
C. 支气管异物以右侧为多，可引起肺不张、肺气肿、肺脓胸、脓胸等继发感染
D. 急救处理首先用拍背法或推腹法进行急救
E. 在可视范围之内能够发现有异物阻塞气道，可将手指伸及该处将阻塞物取出

正确答案：D。急救处理首先用拍背法或推腹法进行急救

解析：本题考查气管及支气管异物的特点。气管或支气管异物自然咳出的机会极低，必须在医院手术的条件下，用喉镜或气管镜将异物取出，因此，应争取尽早送医院急诊处理（D错，为本题正确答案）。气管及支气管异物的特点：多见于学龄前儿童（A对）；气管异物典型的三大体征是喘鸣、异物拍击声、异物撞击声（B对）；支气管异物以右侧为多，可引起肺不张、肺气肿、肺脓胸、脓胸等继发感染（C对）；如在可视范围之内能够发现有异物阻塞气道，可将手指伸及该处将阻塞物取出（E对）。